千柏鼻炎片可用于急慢性鼻炎、急慢性鼻窦炎见鼻塞、流涕黄稠、嗅觉迟钝等症状，其使用注意事项有
A. 高空作业者慎用
B. 前列腺肥大者慎用
C. 外感风寒者慎用
D. 高血压、青光眼患者慎用
E. 肺脾气虚者慎用

正确答案：C、D、E。外感风寒者慎用；高血压、青光眼患者慎用；肺脾气虚者慎用

解析：本题考查的是千柏鼻炎片的注意事项。千柏鼻炎片可用于急慢性鼻炎、急慢性鼻窦炎见鼻塞、流涕黄稠、嗅觉迟钝等症状，其使用注意事项有外感风寒者慎用（C对）、高血压、青光眼患者慎用（D对）、肺脾气虚者慎用（E对）。千柏鼻炎片：【注意事项】外感风寒、肺脾气虚者慎用。高血压、青光眼患者慎用。服药期间，忌食辛辣厚味、油腻、鱼腥发物，戒烟酒。因含千里光，故不宜过量或持久服用。有文献报道，服用本品可引起肝脏损害，偶有胸痛、口干等。鼻炎康片：【注意事项】过敏性鼻炎属虚寒症者慎用。肺脾气虚或气滞血瘀者慎用。运动员慎用。服药期间，戒烟酒，忌辛辣食物。所含苍耳子有小毒，故不宜过量服用或持久服用。含马来酸氯苯那敏，易引起嗜睡，服药期间不得驾驶车、船，不得从事高空作业（A错）、机械作业，以及操作精密仪器等；又因其对H1受体有阻断作用，故膀胱颈梗阻、甲状腺功能亢进、青光眼、高血压和前列腺肥大者慎用（B错）。孕妇及哺乳期妇女慎用。